我国制订大气卫生标准的原则不包括
A. 急性或慢性中毒
B. 对人体健康无间接危害
C. 选用最敏感的指标
D. 对主观感觉无不良影响
E. 对大气的自净作用无影响

正确答案：E。对大气的自净作用无影响

解析：本题考查我国制订大气卫生标准的原则。我国制订大气卫生标准的原则包括：1.保障居民不发生急性中毒或慢性危害（A对）；2.对主观感觉无不良影响（D对）；3.对人体健康无间接影响（B对）；4.选用最敏感指标（C对）。大气自净作用是指大气中的污染物自然分解、沉降、湿润、清除等过程，这些过程可以自然减少大气污染物的浓度，从而达到净化大气的目的。因此，大气自净作用是大气污染物的自然净化过程，而不是我国制定大气卫生标准的原则（E错，为本题正确答案）。